《素问·水热穴论》中称为“胃之关”的是
A. 脾
B. 肾
C. 贲门
D. 幽门
E. 阑门

正确答案：B。肾

解析：肾（B对）者，胃之关也，关门不利，就会导致水液停聚，溢于皮肤，发为浮肿。